炎热环境中（30℃以上），机体维持体热平衡是通过
A. 增加有效辐射面积
B. 增加皮肤与环境之间的温度差
C. 交感神经紧张性增加
D. 发汗及增加皮肤血流量
E. 发汗及减少皮肤血流量

正确答案：D。发汗及增加皮肤血流量